奥拉西坦和吡拉西坦的化学结构上的区别是
A. 吡咯烷N-上有不同的取代基
B. 侧键酰胺N上有不同的取代基
C. 是不同的盐
D. 奥拉西坦吡咯烷环上有羟基取代，吡拉西坦无
E. 吡拉西坦上有氨基取代，奥拉西坦无

正确答案：D。奥拉西坦吡咯烷环上有羟基取代，吡拉西坦无